属于常染色体隐性遗传病的是
A. 神经管缺陷
B. 苯丙酮尿症
C. 21-三体综合征
D. 血友病
E. 多囊肾

正确答案：B。苯丙酮尿症

解析：本题考查常染色体隐性遗传病的相关内容。遗传性代谢缺陷病多为常染色体隐性遗传病，如苯丙酮尿症（B对ACDE错）、肝豆状核变性等。